急性阑尾炎患者，出现寒战、高热及巩膜黄染，最可能的情况是
A. 阑尾坏疽穿孔
B. 阑尾类癌
C. 形成阑尾周围脓肿
D. 门静脉炎
E. 盲肠后位阑尾炎

正确答案：D。门静脉炎

解析：本急性阑尾炎患者出现寒战、高热及巩膜黄染（化脓性门静脉炎的临床表现），所以最可能的情况为并发化脓性门静脉炎（D对）。阑尾坏疽穿孔（A错）刚开始坏疽出现剧烈腹痛，穿孔后因阑尾腔压力剧减，腹痛可减轻。阑尾类癌（B错）少见，起病隐匿，几乎总是在阑尾切除时偶然发现。阑尾周围脓肿（C错）在体检时右下腹饱满，扪及一压痛性肿块，边界不清，位置固定。盲肠后位阑尾炎（E对）的临床症状体征轻，易误诊。